随机抽取的300名大学生身高和体重资料，p＜0.01（a=0.05），说明身高和体重
A. 呈正比
B. 存在相关性
C. 呈反比
D. 存在紧密联系
E. 存在直线相关关系

正确答案：B。存在相关性

解析：随机抽取的300名大学生身高和体重资料，P＜0.01（α=0.05），只能说明身高和体重存在相关性（B对），因为身高和体重的相关关系由相关系数r决定，而题干没有给出r的数值。